某妇女，30岁，孕1产0，宫内妊娠20周，合并子宫壁间肌瘤，主诉：下腹痛7天，合并低热，无阴道流血，WBC：9×109/L，最可能的诊断是
A. 子宫肌瘤合并感染
B. 子宫肌瘤红色变性
C. 子宫肌瘤囊性变
D. 子宫肌瘤蒂扭转
E. 妊娠合并阑尾炎

正确答案：B。子宫肌瘤红色变性

解析：“下腹痛7天，合并低热”为肌瘤红色变性的表现，而且，题干中提示妊娠期合并子宫肌瘤，最先想到的应是红色变性。